男，45岁。突发心脏骤停，经心肺复苏后血压70/40mmHg，心率34次/分，该患者应选用的药物是
A. 阿托品
B. 普罗帕酮
C. 利多卡因
D. 胺碘酮
E. 多巴酚丁胺

正确答案：A。阿托品

解析：该患者突发心脏骤停，经心肺复苏后血压70/40mmHg，心率34次/分，根据临床表现和体征，诊断为缓慢型心律失常，阿托品（A对）为M受体阻断药，通过阻断窦房结M₂受体而解除了迷走神经对心脏的抑制作用，从而引起心率加快，可用于治疗缓慢型心律失常。普罗帕酮（B对）为广谱高效膜抑制性抗心律失常药，能降低心肌兴奋性，延长动作电位时程及有效不应期，延长传导，临床可用于预防和治疗室性和室上性异位搏动，室性或室上性心动过速。利多卡因（C错）阻滞钠通道的激活状态和失活状态，主要用于室性心律失常的治疗。胺碘酮（D错）可抑制心脏多种离子通道，明显延长心肌细胞动作电位时程和有效不应期，主要用于心房扑动、心房颤动、室上性心动过速和室性心动过速。多巴酚丁胺（E错）为β肾上腺素受体激动药，主要用于心肌梗死并发心力衰竭。